患者，女，70岁，BMI21kg/m²，45岁时绝经，10年前开始，经常出现腰背部疼痛，活动后加重，但未就诊，平日外出活动较少，近5年身高降低，驼背明显。10天前患者不慎摔倒，右上肢活动受限、疼痛，就诊后检查结果：血钙1.97mmol/L，血磷1.39mmol/L；右上肢X光检查提示：右桡骨远端骨折。骨密度检查结果：T值为-2.9。入院诊断：右桡骨远端骨折，老年性骨质疏松症。实验室检查结果显示，患者血25-羟维生素D水平降低，医生评估认为患者维生素D严重缺乏，给予骨化三醇治疗，该药物的常用剂量是
A. 一次0.125㎍，一日1次
B. 一次0.5㎍，一日2次
C. 一次0.75㎍，一日2次
D. 一次1.5㎍，一日2次
E. 一次0.25㎍，一日2次

正确答案：E。一次0.25㎍，一日2次

解析：本题考查骨化三醇的使用。骨化三醇的常用剂量是一次0.25㎍，一日2次（E对）。骨化三醇用于治疗绝经后骨质疏松症，常用剂量是一次0.25㎍，一日2次。骨化三醇用于肾性骨营养不良，起始日剂量为0.25㎍，最佳用量为一日0.5～1.0㎍。用于甲状旁腺功能减退和佝偻病，推荐成人起始剂量为一日0.25㎍，每隔2～4周增加剂量，每周至少测定血钙浓度2次。婴儿及儿童：2岁以内的儿童，参考剂量按体重为0.01～0.1㎍/(kg·d） 。